生态系统是在一定空间范围内，由生物群落及其环境组成，借助下列各种功能流所联结的稳态系统。这些功能流是
A. 物质流、能量流、物种流和信息流
B. 物质流、能量流和食物流
C. 物质流、能量流、物种流和食物流
D. 物质流、能量流和信息
E. 都不是

正确答案：A。物质流、能量流、物种流和信息流

解析：本题考查生态系统的相关内容。生态系统是在一定空间范围内，由生物群落及其环境组成,借助于各种功能流（物质流、能量流、物种流和信息流）（A对BCDE错）所联结的稳态系统。